小儿内伤咳嗽最主要的病因是
A. 阳常有余
B. 阴常不足
C. 瘀血内阻
D. 痰浊内生
E. 水饮内停

正确答案：D。痰浊内生

解析：脾主运化水液，小儿脾常不足，运化失职，痰浊内生，上聚于肺，肺为娇脏，其性清宣肃降，肺失宣降，发为咳嗽，为内伤咳嗽主要病因（D对）。阳常有余为万全所提出的理论，为小儿生理特点，非内伤咳嗽病因（A错）。阴常不足亦为万全所提出的小儿生理特点（B错）。内伤咳嗽的病因以痰浊内生及后期的肺气阴两虚为主，瘀血内阻非其病因（C错）。水饮多为肺脾肾三脏失调，水液停留泛滥于内所致，水饮停于肺则为支饮病，症见咳出清稀痰涎，喘急倚息不得平卧（E错）。